呈不规则厚片，外表皮黄褐色或褐色，有皱缩纹；横切片可见明显波状环纹或多角形纹理，纵切片边缘不整齐，呈蝴蝶状的药材是
A. 延胡索
B. 莪术
C. 川芎
D. 三七
E. 白及

正确答案：C。川芎

解析：本题考查的是川芎饮片的性状鉴别。呈不规则厚片，外表皮黄褐色或褐色，有皱缩纹；横切片可见明显波状环纹或多角形纹理，纵切片边缘不整齐，呈蝴蝶状的药材是川芎（C对）。川芎：【性状鉴别】饮片为不规则厚片，外表皮黄褐色或褐色，有皱缩纹。横切片切面黄白色或灰黄色，散有黄棕色小油点，可见明显波状环纹或多角形纹理。纵切片边缘不整齐，呈蝴蝶状，习称“蝴蝶片”，切面灰白色或黄白色，散有黄棕色小油点。质坚实，气浓香，味苦、辛、微甜。延胡索（A错）：【性状鉴别】药材呈不规则扁球形。表面黄色或黄褐色，有不规则网状皱纹，顶端有略凹陷的茎痕，底部常有疙瘩状突起。质硬而脆，断面黄色，角质样，有蜡样光泽。气微，味苦。莪术（B错）：【性状鉴别】药材蓬莪术呈卵圆形、长卵形、圆锥形或长纺锤形，顶端多钝尖，基部钝圆。表面灰黄色至灰棕色，上部环节突起，有圆形微凹的须根痕或有残留的须根，有的两侧各有1列下陷的芽痕和类圆形的侧生根茎痕，有的可见刀削痕。体重，质坚实。断面灰褐色至蓝褐色，蜡样，常附有灰棕色粉末，皮层与中柱易分离，内皮层环纹棕褐色。气微香，味微苦而辛。三七（D错）：【性状鉴别】药材主根呈类圆锥形或圆柱形。表面灰褐色或灰黄色，有断续的纵皱纹和支根痕。顶端有茎痕，周围有瘤状突起。体重，质坚实，断面灰绿色、黄绿色或灰白色，木部微呈放射状排列。气微，味苦回甜。白及（E错）：【性状鉴别】药材呈不规则扁圆形，多有爪状分枝。表面灰白色至灰棕色，或黄白色，有数圈同心环节和棕色点状须根痕，上面有突起的茎痕，下面有连接另一块茎的痕迹。质坚硬，不易折断，切面类白色，角质样。气微，味苦，嚼之有黏性。